腮腺多形性腺瘤切除术应采取
A. 沿包膜摘除肿瘤，保留面神经
B. 包膜外正常组织处切除肿瘤，不保留面神经
C. 深叶肿瘤应切除肿瘤及全腮腺，均保留面神经
D. 浅叶肿瘤除切除肿瘤及浅叶，保留面神经
E. 肿瘤及周围部分腮腺组织切除，不保留面神经

正确答案：D。浅叶肿瘤除切除肿瘤及浅叶，保留面神经

解析：本题考查多形性腺瘤的治疗。腮腺多形性腺瘤切除术应采取浅叶肿瘤除切除肿瘤及浅叶，保留面神经（D对）。多形性腺瘤是唾液腺肿瘤中最常见者，有易种植、好复发的特点，包膜常不完整，肿瘤的包膜与瘤体之间黏着性较差，容易与瘤体相分离，若采用单纯沿包膜摘除肿瘤（A错）的方法，常有复发，故手术原则应从包膜外正常组织进行，同时切除部分或整个腺体。腮腺浅叶肿瘤体积较小者，可做部分腮腺切除术，如浅叶肿瘤除切除肿瘤及浅叶保留面神经。多形性腺瘤除表现面部畸形外,一般都不引起面神经功能障碍，因此为尽量减少术后并发症，保留组织功能，各种术式均要保留面神经（BE错），只有当腮腺恶性肿瘤已侵犯面神经并且临床上出现面瘫者才应牺牲面神经。腮腺深叶肿瘤应切除肿瘤及整个深叶，若切除整个腮腺，往往在腮腺区会造成局部塌陷，面部不对称，影响美观，可在切除腮腺深叶的同时保留腮腺浅叶（C错），这样不仅可缩短手术时间，也可降低腮腺术后常见并发症—弗雷综合征的发生率。